血红蛋自的氧解离曲线是
A. 氢键、盐键、疏水键和二硫键
B. S形
C. 加热
D. 双曲线
E. α螺旋

正确答案：B。S形